主药剂量小于0.1g而制片困难者需加用
A. 稀释剂
B. 吸收剂
C. 黏合剂
D. 润滑剂
E. 崩解剂

正确答案：A。稀释剂

解析：本题考查的是片剂的辅料。主药剂量小于0.1g而制片困难者需加用稀释剂（A对）。稀释剂：适用于主药剂量小于0.1g，或浸膏黏性太大，或含浸膏量多而制片困难者。吸收剂（B错）：适用于原料药（含中间体）中含有较多挥发油、脂肪油或其他液体，而需制片者。黏合剂（C错）：本身具有黏性，能增加药粉间的黏合作用，以利于制粒和压片的辅料。适用于没有黏性或黏性不足的药粒制粒压片。润滑剂（D错）：压片前必须加入的，能增加颗粒（或粉末）流动性，减少颗粒（或粉末）与冲模内摩擦力，具有润滑作用的物料称为润滑剂。崩解剂（E错）：系指能促使片剂在胃肠液中迅速崩解成小粒子而更利于药物溶出的辅料。崩解剂的主要作用是消除因黏合剂和高度压缩而产生的结合力。除口含片、舌下片、缓释片、咀嚼片等，一般片剂均需加用崩解剂。